光照患者左眼，左侧瞳孔缩小，右侧瞳孔不缩小，病灶可能位于
A. 右侧视神经
B. 左侧顶盖前区
C. 右侧动眼神经
D. 右侧外侧腺状体
E. 右侧视束

正确答案：C。右侧动眼神经

解析：光照患者左眼，左侧瞳孔缩小，右侧瞳孔不缩小，病灶可能位于右侧动眼神经（C对）。一侧动眼神经受损时，由于信息传出中断，无论光照哪一侧眼，患侧眼的瞳孔对光反射都消失（患侧眼的瞳孔直接及间接对光反射消失），但健侧眼的瞳孔直接和间接对光反射存在。